男，35岁，从高处跳下时，双下肢顿时感到无力。急救运送的方法是
A. 双人扶着让病人走
B. 一人背着运送
C. 一人抱着运送
D. 一人抬头，一人抬脚运送
E. 躺在木板床上运送

正确答案：E。躺在木板床上运送

解析：患者高空跳下后，双下肢顿时感到无力（提示可能有脊髓损伤），故该患者最可能的诊断为脊柱骨折并脊髓损伤。对于已有或怀疑有脊髓损伤病人，也必须按照脊柱骨折急救方法处理，急救运送的方法是病人平卧木板搬运（E对），可避免搬运过程中对患者造成二次损伤，保持脊柱的稳定性。双人扶着让病人走（A错）、一人背着运送（B错）、一人抱着运送（C错）与一人抬头，一人抬脚运送（D错）等动作十分危险，因为这些方法会增加患者脊柱的弯曲，可将碎骨片向后挤入椎管内，加重脊髓损伤。